根据《药品流通监督管理办法》，关于药品生产、经营企业购销药品行为的说法，错误的是
A. 药品生产、经营企业应对其药品购销行为负责
B. 药品生产、经营企业可派出销售人员以本企业名义从事药品购销活动
C. 药品生产企业可以销售本企业生产的药品
D. 药品生产企业可以销售本企业经许可受委托生产的药品
E. 药品生产、经营企业对其销售人员以本企业名义从事的药品购销行为承担法律责任

正确答案：D。药品生产企业可以销售本企业经许可受委托生产的药品

解析：本题考查的是药品生产、经营企业购销药品行为。根据《药品流通监督管理办法》，关于药品生产、经营企业购销药品行为的说法，错误的是药品生产企业可以销售本企业经许可受委托生产的药品（D错，为本题正确答案）。《药品流通监督管理办法》第九条规定，药品生产企业只能销售本企业生产的药品（C对），不得销售本企业受委托生产的或者他人生产的药品。药品生产、经营企业对其药品购销行为负责（A对），对其销售人员或设立的办事机构以本企业名义从事的药品购销行为承担法律责任（E对）。药品生产企业、药品批发企业派出销售人员销售药品的，除本条前款规定的资料外，还应当提供加盖本企业原印章的授权书复印件。